老年人最常见的继发性肾病
A. 过敏性紫癜肾炎
B. 淋巴瘤性肾病
C. 糖尿病肾病
D. 肾淀粉样变
E. 骨髓瘤性肾病

正确答案：C。糖尿病肾病

解析：糖尿病肾病是老年人最常见的继发性肾病（C对）。